干陷的病机特点是
A. 阴液不足
B. 气血不足
C. 肝肾亏损
D. 阴伤胃败
E. 阴损及阳

正确答案：B。气血不足

解析：内陷根据病变不同阶段的临床表现可分为火陷、干陷和虚陷。其中干陷是指发生于有头疽2～3候溃脓期的病变，其是由于气血两亏，正不胜邪，不能酿化成脓，载毒外泄，以致正虚毒盛而成，即其病机特点是气血亏虚（B对）。阴液不足，火毒炽盛为火陷（发生于有头疽的1～2候毒盛期）的病机特点。虚陷是由于毒邪虽已衰退，而气血大伤，脾气不复，肾阳亦衰，导致生化乏源，阴阳两竭，余毒走窜入营所致。